皮肤的附属器官不包括
A. 皮脂腺
B. 汗腺
C. 指甲
D. 毛发
E. 平衡觉

正确答案：E。平衡觉

解析：毛发（D对）、指（趾）甲（C对）、皮脂腺（A对）、汗腺（B对，故E为本题正确答案）和乳腺均是皮肤的附属结构。